某研究者用同一方法对两个地区30岁以上的成年人进行大肠癌筛查，已知甲地的大肠癌患病率为20/10万，乙地为30/10万，下列说法正确的是
A. 该方法在甲地应用的灵敏度高于乙地
B. 该方法在甲地应用的特异度高于乙地
C. 该方法在甲地应用的阳性预测值低于乙地
D. 该方法在甲地应用的阴性预测值低于乙地
E. 该方法在甲地应用的阳性似然比高于乙地

正确答案：C。该方法在甲地应用的阳性预测值低于乙地

解析：本题考查阳性预测值。由于研究者用同一方法对两个地区30岁以上的成年人进行大肠癌筛查，故灵敏度和特异度是一样的，根据阳性预测值公式，带入甲乙各自的患病率得出该方法在甲地应用的阳性预测值低于乙地（C对ABDE错）。